儿童退热的用药选择和单次用量，正确的是
A. 对乙酰氨基酚25～50mg/kg
B. 对乙酰氨基酚10～15mg/kg
C. 阿司匹林30～60mg/kg
D. 布洛芬0.4～0.6g(12岁以上儿童）
E. 布洛芬20～30mg/kg(1～12岁儿童）

正确答案：B。对乙酰氨基酚10～15mg/kg

解析：本题考查对乙酰氨基酚。对乙酰氨基酚：儿童按体重一次10～15mg/kg（B对A错），每隔4～6小时重复用药1次，每24小时不多于4次。用药不超过3天。布洛芬：成人及12岁以上儿童用于退热、镇痛，一次0.2～0.4g（D错）；用于抗炎，一次0.2～0.6g；一日3～4 次，一日安全剂量按非处方药不超过1.2g 、处方药不超过2.4g（包括复方制剂、栓剂等）。1～12岁儿童，每次5～lOmg/kg（E错），每6小时一次。阿司匹林（C错）避免用于儿童，可能引起Reye's综合征。